疗效、安全性方面的临床资料较少的抗菌药物
A. 一级使用级
B. 备用使用级
C. 特殊使用级
D. 限制使用级
E. 非限制使用级抗菌药物临床应用管理分级

正确答案：C。特殊使用级

解析：特殊使用级抗菌药物是指具有以下情形之一的抗菌药物：①具有明显或者严重不良反应，不宜随意使用的抗菌药物；②需要严格控制使用，避免细菌过快产生耐药的抗菌药物；③疗效、安全性方面的临床资料较少的抗菌药物；④价格昂贵的抗菌药物。掌握“抗菌药物临床应用概述及管理”知识点。